尿液呈碱性时抗菌活性增加、使肾毒性减轻的抗生素类别是
A. 头孢菌素类
B. 大环内酯类
C. 碳青霉烯类
D. 林可霉素类
E. 氨基糖苷类

正确答案：E。氨基糖苷类

解析：本题考查饮食对药物疗效的影响。尿液呈碱性时抗菌活性增加、使肾毒性减轻的抗生素类别是氨基糖苷类（E对）。氨基糖苷类抗生素在碱性环境下抗菌活性更强，还可避免药物解离，减轻肾毒性。头孢菌素类（A错）在酸性或碱性环境下易降解。大环内酯类（B错）、林可霉素类（D错）在碱性环境下活性更强，毒性低微，主要副作用是胃肠道反应。碳青霉烯类（C错）有肾毒性，但在碱性环境下无抗菌活性增强、肾毒性减轻的表现。